32岁，外阴瘙痒伴分泌物多4~5天，妇科检查：阴道黏膜散在红色斑点，阴道内多量脓性泡沫状分泌物，有臭味。此病人治疗应首选
A. 局部用药即可达治愈
B. 全身及局部同时用药效果最佳
C. 使用碱性液冲洗阴道可提高疗效
D. 症状消失复查分泌物转阴即停药
E. 男方不易感染，无需用药治疗

正确答案：B。全身及局部同时用药效果最佳

解析：中青年女性，外阴瘙痒伴分泌物多4～5天，妇科检查：阴道黏膜散在红色斑点（滴虫阴道炎典型体征），阴道内多量脓性泡沫状分泌物（滴虫阴道炎分泌物的典型特点），有臭味，根据患者的症状及体征，考虑最可能的诊断为滴虫阴道炎，此病人治疗应首选全身及局部同时用药效果最佳（B对），治愈此病需全身用药，局部用药（A错）并不能达到治愈效果。该病再感染率很高，最初感染3个月内需要追踪、复查（D错），该病主要由性行为传播，性伴侣应同时进行治疗（E错），碱性液冲洗阴道并不能提高疗效（C错）。